外感病如见舌色绛，多提示
A. 气分大热
B. 上焦湿热
C. 阴虚火旺
D. 胃肠热甚
E. 热入营血

正确答案：E。热入营血

解析：绛舌多是红舌进一步发展而成。其形成的原因是热入营血，气血沸涌，耗伤营阴，血液浓缩；或虚火旺盛，上炎于舌络，血络充盈，故舌呈绛色（E对）。气分病（A错）是温热病的第二阶段，发热较重不恶寒，口渴，苔黄，脉数是它的特点。上焦湿热（B错）的主要症状为头部发热，咳嗽、逆喘，痰多，舌苔白腻，入睡困难，烦热盗汗，小便短赤，口干口苦等。阴虚火旺（C错）以心烦失眠、口燥咽干、盗汗遗精、两颧潮红、小便短黄、大便干结，或咳血、衄血，或舌体、口腔溃疡，舌红少津，脉细数等为常见证候。胃肠热甚（D错）则见舌苔深黄，厚而干燥，甚或老黄焦裂起芒刺，面赤身热，汗大出，大便秘结等证。